地西泮含量测定所使用的滴定液是
A. 高氯酸滴定液
B. 亚硝酸钠滴定液
C. 氢氧化钠滴定液
D. 盐酸滴定液
E. 硝酸银滴定液

正确答案：A。高氯酸滴定液

解析：本题考查非水碱量法。地西泮含量测定所使用的滴定液是高氯酸滴定液（A对）。地西泮结构中的氮原子具有弱碱性，原料药可采用非水溶液滴定法测定含量。方法：取本品约0.2g，精密称定，加冰醋酸与醋酐各10ml溶解后，加结晶紫指示液1滴，用高氯酸滴定液（0.1mol/L）滴定，至溶液显绿色，并将滴定结果用空白试验校正。亚硝酸钠滴定法是用亚硝酸钠滴定液（B错）在盐酸溶液中与芳伯氨基定量发生重氮化反应，生成重氮盐以测定药物含量的方法。氢氧化钠滴定（C错）和盐酸滴定（D错）均属于酸碱滴定法，适用于一般的酸、碱以及能与酸、碱直接或间接发生质子转移的物质。硝酸银滴定（E错）常用于沉淀滴定法，是利用银离子与卤素离子反应或银离子产生沉淀来测定含量。